免疫缺陷患者不可接种的疫苗
A. 灭活脊髓灰质炎疫苗
B. 流行性出血热疫苗
C. 麻疹活疫苗
D. 多糖疫苗
E. 重组乙型肝炎疫苗

正确答案：C。麻疹活疫苗

解析：麻疹活疫苗属于减毒活疫苗，是用减毒或无毒力的病原微生物制成，疫苗在体内存在着回复突变的危险，所以免疫缺陷者一般不宜接种（C对）；灭活脊髓灰质炎疫苗（A错）和流行性出血热疫苗（B错）同属于死疫苗，是用免疫原性强的病原体经理化方法灭活制成，灭活的病原体不能进入宿主细胞内增殖；多糖疫苗（D错）、重组乙型肝炎疫苗（E错）同属于亚单位疫苗，亚单位疫苗不具备致病性，故免疫缺陷患者可以接种。